某心理医师开了一家咨询所，聘请心理治疗师来给予心理咨询，卫生部门得知后，予以心理咨询师处罚，请问处罚的理由是什么
A. 未变更执业地点
B. 擅自予以心理咨询
C. 未征得原单位同意
D. 未给予行政部门备案
E. 注册地点之外的机构开展医疗活动

正确答案：E。注册地点之外的机构开展医疗活动

解析：某心理医师开了一家咨询所，聘请心理治疗师来给予心理咨询，它在注册地点之外的机构开展医疗活动，故卫生部门得知后，予以心理咨询师处罚（E对ABCD错）。